某初中学生，学习压力增加，一次体检时其血压值处于同性别同年龄组的P₉₇。医生应该建议其
A. 在其他时间再测量1次血压
B. 在其他时间再测量2次血压
C. 在其他时间再测量3次血压
D. 在其他时间再测量4次血压
E. 在其他时间再测量5次血压

正确答案：B。在其他时间再测量2次血压